茯苓的主产地之一是
A. 陕西
B. 山西
C. 安徽
D. 四川
E. 贵州

正确答案：C。安徽

解析：本题考查的是茯苓的产地。茯苓的主产地之一是安徽（C对）。茯苓：【产地】主产于安徽、云南和湖北，河南、贵州、四川等省亦产。主产于陕西（A错）的药材有藁本、茜草、淫羊藿、沙苑子、南五味子、猪苓等。主产于山西（B错）的药材有苦参、远志、党参、香加皮、蒲公英、连翘、硫黄等。主产于四川（D错）的药材为川药。川药：主产地四川、西藏等。如川贝母、川芎、黄连、川乌、附子、麦冬、丹参、干姜、白芷、天麻、川牛膝、川楝子、川楝皮、川续断、花椒、黄柏、厚朴、金钱草、五倍子、冬虫夏草、麝香等。主产于贵州（E错）的药材为贵药。贵药：主产地贵州。如天冬、天麻、黄精、杜仲、吴茱萸、五倍子、朱砂等。